舌癌的最好发部位
A. 舌尖
B. 舌背
C. 舌根
D. 舌腹
E. 舌侧缘

正确答案：E。舌侧缘

解析：本题考查舌癌的好发部位。舌癌是最常见的口腔癌之一。其最好发部位为舌侧缘（E对），这与尖锐牙尖、不良修复体等的刺激有一定关系，其次是舌尖（A错）、舌背（B错）、舌腹（D错），舌根（C错）很少见。